某女，29岁。恶寒，发热（体温37.5℃），无汗头痛，肢体酸痛，鼻寒声重，鼻痒喷嚏，流涕清稀，咽痒，咳嗽，咳痰稀白；舌苔薄白，脉浮紧。宜选用的基础方剂是
A. 银翘散
B. 清瘟败毒饮
C. 荆防败毒散
D. 香薷饮
E. 参苏饮

正确答案：C。荆防败毒散

解析：本题考查感冒之风寒感冒的基础方剂。结合患者症状为感冒之风寒感冒，宜选用的基础方剂是荆防败毒散（C对）。感冒之风寒感冒【症状】恶寒重，发热轻，无汗头痛，肢体酸痛，或鼻塞声重，或鼻痒喷嚏，流涕清稀，咽痒，咳嗽，咳痰稀白。舌苔薄白，脉浮紧。【方剂应用】基础方剂荆防败毒散（荆芥、防风、前胡、柴胡、羌活、独活、川芎、茯苓、枳壳、桔梗、甘草）加减。感冒之风热感冒【症状】身热较著，微恶风，头胀痛，或咳嗽少痰，或痰出不爽，咽痛咽红，口渴。舌边尖红，苔薄白或微黄，脉浮数。【方剂应用】基础方剂银翘散（A错）（金银花、连翘、竹叶、荆芥、牛蒡子、薄荷、桔梗、淡豆豉、甘草）加减。感冒之时行感冒【症状】突然发热，高热不退，甚则寒战，周身酸痛，无汗，咳嗽，口干，咽喉疼痛，伴明显全身症状，呈现流行性发作。舌红，苔黄，脉浮数。【方剂应用】基础方剂清瘟败毒饮（B错）（石膏、生地、犀角、栀子、丹皮、黄连、桔梗、黄芩、知母、赤芍、玄参、连翘、竹叶、甘草）加减。中暑之阴暑【症状】发热恶寒，无汗，身重疼痛，神疲倦怠，舌质淡，苔薄黄，脉弦细。【方剂应用】基础方剂香薷饮（D错）（香薷、厚朴、白扁豆）加减。感冒之气虚感冒【症状】发热，恶寒较甚，无汗，头痛鼻塞，身楚倦怠，咳嗽，痰白，咳痰无力。舌淡，苔白，脉浮而无力。【方剂应用】基础方剂参苏饮（E错）（人参、苏叶、甘草、茯苓、葛根、前胡、半夏、枳壳、桔梗、陈皮、木香）加减。